阴偏衰的症候性质是指
A. 假热证
B. 假寒证
C. 虚热证
D. 实热证
E. 虚寒证

正确答案：C。虚热证

解析：阴偏衰，阴不制阳，阳相对亢盛而形成阴虚内热、阴虚火旺和阴虚阳亢等多种病变，表现出虚热及虚性亢奋的症状（C对）。实热证由阳偏盛而阴未虚形成（D错）。假热证与假寒证分别由“阴盛格阳”（A错）和“阳盛格阴”（B错）形成。虚寒证由阳偏衰形成（E错）。